患儿，6岁。2个月来胃纳不振，精神疲倦，伴有低热，遍身汗出，微恶风寒。治疗应首选
A. 玉屏风散
B. 牡蛎散
C. 生脉散
D. 黄芪桂枝五物汤
E. 当归六黄汤

正确答案：D。黄芪桂枝五物汤

解析：患儿2个月来胃纳不振，精神疲倦，伴有低热，遍身汗出，微恶风寒诊断为汗证营卫失调证，治以调和营卫，方选黄芪桂枝五物汤（D对）。玉屏风散用于肺卫不固（A错）。牡蛎散用于益气固表，敛阴止汗（B错）。生脉散用于气阴亏虚（C错）。当归六黄汤滋阴清热（E错）。